患者女性，31岁，左下后牙、左下颌角区反复肿胀3个月，开口困难。检查开口度一指半，阻生牙牙龈充血糜烂，挤压有少量脓液溢出，嚼肌区膨隆明显，质硬，轻度压痛。此时最简单有效的X线检查方法为
A. 左下颌升支切线位片+左下颌骨侧位片
B. 下颌体腔片+左下颌骨侧位片
C. 左下颌后部横断咬合片+左下颌骨侧位片
D. CT
E. 核磁共振

正确答案：A。左下颌升支切线位片+左下颌骨侧位片

解析：本题考查牙源性边缘性颌骨骨髓炎的影像学表现。下颌骨升支切线位片用于检查一侧升支外侧骨密质膨出、增生及破坏情况，下颌骨侧位片用于检查下颌骨体部、升支及髁状突的改变，此患者诊断为左下颌骨边缘性骨髓炎，可通过左下颌升支切线位片+左下颌骨侧位片（A对）检查观察下颌骨升支体部骨质的破坏情况。下颌体腔片（B错）可显示出下颌骨颏部的骨质情况，而此患者的病变部位位于嚼肌区，不能全面反映病变部位的影像。下颌横断咬合片（C错）可显示下颌骨体以及下牙弓的横断面影像，主要用于观察下颌骨体部颊舌侧骨质有无膨胀、增生以及破坏，此患者患有边缘性骨髓炎，除下颌骨体部，下颌升支的影像也需拍摄出来，因此下颌体腔片不能让医生全面了解患者病情。CT（D错）主要用于颌面部肿瘤的诊断，且费用较为昂贵，此患者为边缘性骨髓炎，只需拍摄普通的X线片即可。核磁共振（E错）对软组织和血管成像较为逼真，而此患者的病变部位位于下颌骨，核磁共振对此患者的病情成像并无太大帮助。